在血浆蛋白电泳中，泳动最慢的蛋白质是
A. 清蛋白
B. α₁-球蛋白
C. α₂-球蛋白
D. β-球蛋白
E. γ-球蛋白

正确答案：E。γ-球蛋白